患儿泻下稀薄，粪色深黄而臭，肛门灼热，其证候是
A. 风寒泻
B. 伤食泻
C. 脾虚泻
D. 湿热泻
E. 脾肾阳虚泻

正确答案：D。湿热泻

解析：患儿以泻下稀薄为主症，当属泄泻，其湿热之邪，蕴结脾胃，下注大肠，传化失职，故见泻下稀薄或如水注。湿性黏腻，热性急迫，湿热交蒸，壅遏肠胃气机，故见泻下色黄而臭，肛门灼热（D对）。风寒泻以大便清稀夹有泡沫，臭气不甚，肠鸣腹痛为特征（A错）。伤食泻特征为起病前有乳食不节史，便稀夹不消化物，气味酸臭，脘腹胀痛，泻后痛减（B错）。脾虚泻可见大便稀溏，多于食后作泻，以及全身脾虚征象（C错）。脾肾阳虚泻本证见于久泻，以大便澄澈清冷，完谷不化，形寒肢冷为特征（E错）。